某女，28岁，怀孕7个月。患者自怀孕起反复呕恶，厌食，甚至食入即吐，此属
A. 妊娠恶阻
B. 脾胃虚弱
C. 食滞胃脘
D. 湿热蕴脾
E. 早孕反应

正确答案：A。妊娠恶阻

解析：女子妊娠早期，见厌食恶心，或食入即吐，此属妊娠反应，乃因妊娠后血聚于下养胎，冲脉之气盛，上逆犯胃，胃失和降所致；重者会出现，厌食，呕吐频繁，甚至食入即吐的症状，称为“妊娠恶阻”（A对）。脾胃虚弱的临床表现为病程较长，泄泻时轻时重、或时发时止，大便稀溏，色淡无臭味，夹有不消化食物残渣，食后易泻，吃多后见腹胀、大便多，平素食欲不振，面色萎黄，神疲倦怠，形体瘦弱，舌质淡，苔薄白，脉虚无力，本题临床表现与之不符（B错）。食滞胃脘证临床表现为胃脘胀满疼痛、拒按，厌恶食物，嗳腐吞酸，或呕吐酸馊食物，吐后胀痛得减，或腹胀腹痛，泻下不爽，肠鸣，矢气臭如败卵，大便酸腐臭秽，舌苔厚腻，脉滑，本题临床表现与之不符（C错）。湿热蕴脾证以腹胀、纳呆、便溏及湿热症状为主要临床表现（D错）。患者已怀孕7个月，不属于早孕反应（E错）。